某男，诊断为肺结核，症见咳呛气急，痰少黏稠，时时咳血，血色鲜红，午后潮热，五心烦热，骨蒸颧红，盗汗量多，心烦失眠，性急善怒，胁肋掣痛，形体日渐消瘦，舌红绛而干，苔黄，脉细数。其治法宜选
A. 滋阴补阳
B. 滋阴降火
C. 益气养阴
D. 滋阴润肺
E. 化痰止咳

正确答案：B。滋阴降火

解析：肺结核四个证型分别为肺阴亏损证、阴虚火旺证、气阴耗伤证、阴阳两虚证。本题患者为肺结核，痨邪客肺，日久伤阴，肺伤咳甚，邪久化热，更损肺阴，故痰少而粘稠，不易咯出，甚至络伤而咯血痰。阴虚不能制阳，虚热内生则午后潮热，五心烦热，骨蒸颧红，盗汗量多，心烦失眠；舌红绛而干，苔黄，脉细数是久病伤阴，脏气亏虚之象，治法宜滋阴降火（B对）；滋阴补阳是咳痰色白，面浮肢肿，形寒的阴阳两虚证的治法（A错）；益气养阴是咳嗽无力，气短声低，咳痰清稀色白量多，午后潮热，伴有畏风怕冷的气阴耗伤证的治法（C错）；滋阴润肺是干咳，手足心热，皮肤干灼，口咽干燥的肺阴亏损证的治法（D错）；因患者有少量粘稠的黄痰，则不应止咳。如果用止咳药，会导致痰液留在体内，反而容易引起肺炎等呼吸道感染性疾病（E错）。